糖尿病患者高渗性昏迷抢救宜选用
A. 胰岛素皮下注射
B. 胰岛素静脉注射
C. 格列齐特口服
D. 罗格列酮口服
E. 瑞格列奈口服

正确答案：B。胰岛素静脉注射

解析：本题考查治疗糖尿病药物的适应症。糖尿病患者高渗性昏迷抢救宜选用胰岛素静脉注射（B对）。胰岛素静脉注射可以用于抢救糖尿病酮症酸中毒和高血糖高渗性昏迷。胰岛素皮下注射（A错）用于常规治疗糖尿病。格列齐特口服（C错）用于治疗Ⅱ型糖尿病。罗格列酮口服（D错）用于治疗Ⅱ型糖尿病和胰岛素耐药性。瑞格列奈口服（E错）用于治疗饮食控制、降低体重与运动不能有效控制高血糖的Ⅱ型糖尿病。